在中脑内的脑神经核是
A. 三叉神经运动核
B. 黑质
C. 动眼神经核
D. 红核
E. 面神经核

正确答案：C。动眼神经核

解析：动眼神经核（C对）位于中脑内。三叉神经运动核（A错）、面神经核（E错）均位于脑桥内。黑质（B错）、红核（D错）均位于中脑内，但因两核不与脑神经相连，故不属于脑神经核。